属于钠通道阻滞剂的抗心律失常药是
A. 利多卡因
B. 索他洛尔
C. 美托洛尔
D. 硝酸甘油
E. 维拉帕米

正确答案：A。利多卡因

解析：本题考查抗心律失常药。利多卡因（A对）属于钠通道阻滞剂的抗心律失常药。索他洛尔（B错）为延长动作电位时程药。维拉帕米（E错）为钙通道阻滞剂。硝酸甘油（D错）为硝酸酯类抗心绞痛药。